小建中颗粒除温中补虚外，又能
A. 缓急止痛
B. 理气止痛
C. 疏肝止痛
D. 消积止痛
E. 制酸止痛

正确答案：A。缓急止痛

解析：本题考查的是小建中颗粒的功能。小建中颗粒的功能为温中补虚，缓急止痛（A对）。小建中颗粒：【功能】温中补虚，缓急止痛。香砂平胃丸：【功能】理气化湿，和胃止痛（B错）。左金丸：【功能】泻火，疏肝，和胃，止痛（C错）。六味安消散：【功能】和胃健脾，消积导滞，活血止痛（D错）。牡蛎：【功效】平肝潜阳，镇惊安神，软坚散结，收敛固涩，制酸止痛（E错）。